鱼类脂肪具有降低血脂，预防动脉粥样硬化的作用，主要与其富含
A. 饱和脂肪酸
B. 中链多不饱和脂肪酸
C. 长链多不饱和脂肪酸
D. 短链多不饱和脂肪酸
E. 以上都对

正确答案：C。长链多不饱和脂肪酸